在实际调查中，哪两种抽样方法最为常用
A. 单纯随机抽样和系统抽样
B. 系统抽样和分层抽样
C. 单纯随机抽样和分层抽样
D. 分层抽样和整群抽样
E. 系统抽样和整群抽样

正确答案：D。分层抽样和整群抽样

解析：本题考查常用的抽样调查方法。在实际工作中，最常用的抽样调查方法为分层抽样和整群抽样（D对ABCE错）。分层抽样是从一个可以分成不同子总体（或称为层）的总体中，按规定的比例从不同层中随机抽取样品（个体）的方法。整群抽样是指整群地抽选样本单位，对被抽选的各群进行全面调查的一种抽样组织方式。